连于上肢带骨之间的是
A. 胸骨柄上缘
B. 锁骨上缘
C. 胸肋关节
D. 肩锁关节
E. 肋椎关节

正确答案：D。肩锁关节

解析：上肢带骨包括锁骨和肩胛骨，肩锁关节（D对）就是连于锁骨和肩胛骨上肩峰的关节，即连于上肢带骨。